麻疹最常见的并发症是
A. 肺炎
B. 脑膜脑炎
C. 心肌炎
D. 急性肾炎
E. 关节炎

正确答案：A。肺炎

解析：支气管肺炎（A对）为麻疹最常见的并发症，多发生于出疹期。多见于5岁以下患儿，约占10%或稍多，为麻疹死亡的主要原因，占麻疹患儿死因的90%以上。麻疹并发中枢神经系统病变（B错）较其他出疹性疾病为多，发病率约0.01%～0.5%。常出现高热、剧烈头痛、呕吐、不同程度的意识障碍、瘫痪等，脑膜刺激征及病理征阳性，脑脊液细胞数增至50～500个/mm3，以单核细胞为多，蛋白稍增高，糖正常。病情大多危重，病死率约15%，多数可恢复，部分患者可遗留强直性瘫痪、智力障碍、失明、癫痫等后遗症。麻疹并发心肌炎（C错）多见于2岁以下幼儿。麻疹少见急性肾炎（D错）、肝炎及关节炎（E错）等并发症。